关于卡托普利结构中巯基作用的说法，错误的是
A. 可与酶中锌离子结合，是关键的药效团
B. 可产生皮疹和味觉障碍的副作用
C. 可与半胱氨酸形成结合物，参与排泄
D. 分子间易形成二聚合物，失去活性
E. 巯基不易被氧化代谢，故作用持久

正确答案：E。巯基不易被氧化代谢，故作用持久

解析：本题考查卡托普利的性质和代谢。由于巯基的存在，卡托普利易被氧化（E错，为本题正确答案），能够发生二聚反应而形成二硫键。